下列药材用麸炒法的药材是
A. 斑蝥
B. 苍术
C. 水蛭
D. 阿胶
E. 枳壳

正确答案：B、E。苍术；枳壳

解析：本题考查的是麸炒。列药材用麸炒法的药材是苍术（B对）与枳壳（E对）。麸炒是将净制或切制后的药物用麦麸熏炒的方法。麸炒的目的：①增强疗效，如山药、白术、芡实等。②缓和药性，如苍术、枳实、薏苡仁等。③矫臭矫味，如僵蚕等。常用麸炒的药材有苍术、枳壳等。斑蝥（A错）常用米炒法。米炒是将净制或切制后的药物与米同炒的方法。米炒的目的：①增强药物的健脾止泻作用，如党参。②降低药物的毒性，如红娘子、斑蝥。③矫正不良气味，如昆虫类药物。水蛭（C错）常用滑石粉炒法。滑石粉炒，又称滑石粉烫，是将净制或切制后的药物与滑石粉共同拌炒的方法。滑石粉炒的目的：①使药物质地酥脆，便于粉碎和煎煮，如黄狗肾等。②降低毒性及矫正不良气味，如刺猬皮、水蛭等。阿胶（D错）常用蛤粉炒。蛤粉炒，又称蛤粉烫，是将净制或切制后的药物与蛤粉共同拌炒的方法。蛤粉炒的目的：①使药物质地酥脆，便于制剂和调剂。②降低药物的滋腻之性，矫正不良气味。如阿胶、鹿角胶等。